男，70岁。饮酒1小时后呕咖啡样物100ml，后排黑便100g。既往体健。查体：P110次/分，BP90/50mmHg。首选的治疗药物是
A. 多巴胺
B. 硫糖铝
C. 止血芳酸
D. 纳洛酮
E. 奥美拉唑

正确答案：E。奥美拉唑

解析：患者老年男性，饮酒l小时后呕咖啡样物100ml，后排黑便100g，BP90/50mmHg，提示有上消化道出血（呕血和黑便是上消化道出血的特征性表现）。奥美拉唑静脉注射可用于消化性溃疡急性出血的治疗（E对）。奥美拉唑是质子泵抑制剂，其抑酸机制为选择性的抑制胃壁细胞H⁺-K⁺-ATP酶，当其被抑制时任何作用于壁细胞受体的活性物质均不能发挥作用，因此其抑制胃酸作用强大而持久，具有保护胃黏膜，改善胃黏膜循环的功能，可显著降低24h胃内酸度，使出血区域持续维持pH值6.0以上水平。保证止血最佳效果，既阻断了高酸对溃疡面的侵蚀，又使体液与血小板诱导的止血作用得以发挥，有助于血小板聚集，凝血块的形成而促进止血作用。硫糖铝（B错）是胃粘膜保护剂。多巴胺（A错）（P173）大剂量使用时有缩血管作用，能增加左心室后负荷。止血芳酸（C错）适用于纤维蛋白溶解过程亢进所致出血。纳洛酮（D错）（P881）：是阿片类麻醉药的解毒药，对麻醉镇痛药引起的呼吸抑制有特异性拮抗作用，也用于治疗阿片类药物及其他麻醉性镇痛药。